流脑皮肤瘀点瘀斑不断增加，考虑DIC，应及早应用的药物是
A. 青霉素
B. 甘露醇
C. 头孢菌素
D. 肾上腺皮质激素
E. 肝素

正确答案：E。肝素

解析：流脑患者高度怀疑有 DIC宜尽早应用肝素（E对），剂量为0.5～1.0mg/kg，以后可4～6小时重复一次。应用肝素时，应监测凝血时间，维持在正常值的2.5～3倍为宜。多数应用1～2次见效而停用。高凝状态纠正后，应输入新鲜血液、血浆及维生素K，以补充被消耗的凝血因子。一旦高度怀疑流脑，应在30分钟内给予抗菌治疗。尽早、足量应用细菌敏感并能透过血脑屏障的抗菌药物。常选用以下抗菌药物：青霉素（A错）、头孢菌素（C错）。